男孩，1岁。发热伴咳嗽3天，食欲差。偶有呕吐，嗜睡，抽搐2次，双肺可闻及中细湿啰音，心率110次/分，呼吸56次/分，肝肋下1cm，白细胞4×10⁹/L。病程中出现烦燥不安，脑脊液压力增高。可能并发
A. 中毒性脑病
B. 脓胸
C. 心衰
D. DIC
E. 癫痫

正确答案：A。中毒性脑病

解析：患儿发热、咳嗽、双肺闻及中细湿啰音、呼吸频率增快，应诊断为急性支气管肺炎。患儿嗜睡、抽搐、肝肿大，应考虑为重症支气管肺炎。重症肺炎患儿若出现烦躁不安、脑脊液压力增高，应考虑并发中毒性脑病（A对）。并发脓胸常表现为高热不退、呼吸困难加重、患侧呼吸运动受限、叩诊浊音（B错）。并发心衰常表现为呼吸频率增快＞60次/分、心率突然增快＞180次/分、明显发绀、心音低钝等（C错）。并发弥散性血管内凝血（DIC）常表现为血压下降、四肢发凉、脉速而弱、皮肤黏膜及胃肠道出血（D错）。癫痫不是肺炎的并发症（E错）。